关于精神病因学的叙述，正确的是
A. 5-羟色胺递质紊乱是躁狂发作的病因
B. 性格缺陷是焦虑障碍的主要病因
C. 精神障碍均主要由心理因素导致
D. 极具严重的精神刺激是急性应激障碍发病的直接原因
E. 生活事件是精神分裂症发病的主要因素

正确答案：D。极具严重的精神刺激是急性应激障碍发病的直接原因

解析：心理、社会因素即可以作为原因因素在精神障碍的发病中起重要作用，也可以作为相关因素影响精神障碍的发生、发展，还可在躯体疾病的发生、发展中起作用，极具严重的精神刺激是急性应激障碍发病的直接原因（D对）。而5-HT功能增高可能与躁狂症的发病有关（7版精神病学P4），并不能说5-羟色胺递质紊乱是躁狂发作的病因（A错）。性格缺陷并不是焦虑障碍的主要病因（B错），遗传在焦虑障碍发病病因中占多数。精神障碍是一类具有诊断意义的精神方面的问题，特征为认知、情绪、行为等方面的改变，可伴有痛苦体验和（或）功能损害，但精神障碍与其他躯体疾病一样，均是生物、心理社会（文化）因素相互作用所致，因此精神障碍并非都是主要由心理因素导致（C错）。尽管不少研究表明精神分裂症的发生与心理社会因素有关，但迄今为止尚未任何能决定是否发生精神分裂症的心理社会因素，遗传因素是精神分裂症发病的主要因素（E错）。